随机抽取某市10岁女孩100名，测得其体重均数为35kg，若以一定概率估计该市10岁女孩体重的总体均数所在范围，需进行
A. 点估计
B. 区间估计
C. 假设检验
D. 医学参考值范围
E. 均数的标准误

正确答案：B。区间估计